外阴阴道念珠菌病最主要传染途径是
A. 性交传染
B. 血行传染
C. 直接传染
D. 间接传染
E. 内源性传染

正确答案：E。内源性传染

解析：外阴阴道念珠菌病是由念珠菌引起的常见外阴阴道炎症。传染途径主要为内源性传染（E对），念珠菌属于条件致病菌，可寄生于阴道、口腔及肠道等处，一旦条件适宜即可引起感染（常见的发病诱因有应用广谱抗生素、妊娠、糖尿病、大量应用免疫抑制剂以及接受大量雌激素治疗等），这三个部位的念珠菌可相互传染。也可通过性交直接传染，但较少见（A错）。少部分患者通过接触感染的衣物间接传染（C错）。